调节氧化磷酸化的重要激素是
A. 生长激素
B. 胰岛素
C. 甲状腺素
D. 胰高血糖素
E. 甲状旁腺激素

正确答案：C。甲状腺素

解析：氧化磷酸化是体内ATP生成的主要方式，调节氧化磷酸化的最重要的激素是甲状腺素（C对）：①甲状腺激素可诱导细胞膜上Na⁺，K⁺-ATP酶的生成，使ATP加速分解为ADP和Pi，ADP增多可促进氧化磷酸化，导致机体耗氧量增加；②甲状腺激素可诱导解耦联蛋白基因表达，引起物质氧化释能和产热比率均增加，ATP合成减少，促进氧化磷酸化的进行。生长激素（A错）、胰岛素（B错）、胰高血糖素（D错）、甲状旁腺激素（E错）等均不是调节氧化磷酸化的激素。